关于普萘洛尔抗心律失常的机制，哪项锆误
A. 阻断心肌β受体
B. 降低窦房结的自律性
C. 降低普肯耶纤维的自律性
D. 治疗量就延长普氏纤维的有效不应期
E. 延长房室结的有效不应期

正确答案：D。治疗量就延长普氏纤维的有效不应期